原发性肝癌定位诊断下述哪个方面最敏感
A. X线肝血管造影
B. CT肝动脉碘油造影
C. CT肝动脉造影
D. 放射性核素肝显像
E. X线门静脉造影

正确答案：B。CT肝动脉碘油造影

解析：CT肝动脉碘油造影（八年制八版外科学第二版P620）（B对）是在肝动脉内注入碘化油后再行CT检查，显示直径仅2mm的微小肝癌，因此对原发性肝癌的定位诊断最敏感。